新生儿期筛查苯丙酮尿症实验室检测方法为
A. 尿三氯化铁试验
B. DNA分析
C. 尿2，4-二硝基苯肼试验
D. 血苯丙氨酸浓度测定
E. 染色体核型分析

正确答案：D。血苯丙氨酸浓度测定

解析：本题考查新生儿期筛查苯丙酮尿症的实验室检测方法。对于出生72小时且哺乳6～8次以上的新生儿，筛查苯丙酮尿症需采集足跟外周血于干滤纸片，采用荧光法或串联质谱法（MS /MS）测定血苯丙氨酸（Phe）（D对ABCE错）浓度进行HPA筛查。